下牙槽神经阻滞麻醉时出现面瘫，一般的处理方法为
A. 注射维生素B₁、B₁₂
B. 局部热敷
C. 局部理疗
D. 口服镇静剂
E. 不作特殊处理

正确答案：E。不作特殊处理

解析：本题考查暂时性面瘫的处理方法。暂时性面瘫一般多见于下牙槽神经麻醉口内法注射时，由于注射针偏向内后不能触及骨面，或偏上越过下颌切迹，而致麻药注入腮腺内麻醉面神经而发生暂时性面瘫；偶见于咀嚼肌神经阻滞注射过浅。这种情况待麻醉药作用消失后，神经功能即可恢复，不作特殊处理（E对）。当注射针刺入神经造成神经损伤，出现感觉异常时，可采用针刺、理疗，给予激素、维生素B₁、B₁₂（A错）等神经营养药物治疗。当局麻后发生注射区疼痛，并已发生疼痛、水肿、炎症时，可局部热敷（B错）、局部理疗（C错）、封闭或给予消炎、止痛药物。镇静剂有助于缓解人们的抑郁和焦虑，口服镇静剂（D错）常用来治疗精神紧张的，对面瘫没有治疗作用。